关于复发性流产，下列哪项是错误的
A. 每次流产往往发生在不同妊娠月份
B. 临床过程和一般流产相同
C. 连续与同一性伴侣连续自然流产3次以上者
D. 病因之一与染色体异常有关
E. 晚期复发性流产常因宫口松弛引起

正确答案：A。每次流产往往发生在不同妊娠月份

解析：复发性流产每次流产多发生在同一妊娠月份。掌握“自然流产”知识点。